释放组胺引起过敏症状的细胞是
A. 中性粒细胞
B. 嗜碱性粒细胞
C. 嗜酸性粒细胞
D. 淋巴细胞
E. 血小板

正确答案：B。嗜碱性粒细胞